三期尘肺的X线诊断标准是
A. 有密集度3级的小阴影，分布范围不超过4个肺区
B. 在二期尘肺的基础上，出现小阴影聚集
C. 有阴影出现，其长径不小于2cm，宽径不小于1cm
D. 有密集度2级的小阴影，分布范围达到4个肺区
E. 多个大阴影面积的总和超过右上肺区面积

正确答案：C。有阴影出现，其长径不小于2cm，宽径不小于1cm